雄黄主含
A. As₂S₃
B. As₂S₂
C. As₂O₃
D. FeS₂
E. HgS

正确答案：B。As₂S₂

解析：本题考查的是雄黄的来源。雄黄主含As₂S₂（B对）。雄黄：【来源】为硫化物类矿物雄黄族雄黄。主含二硫化二砷（As₂S₂）。As₂O₃（C错）为砒石的有毒成分。FeS₂（D错）为自然铜的主要成分。自然铜：【来源】为硫化物类矿物黄铁矿族黄铁矿。主含二硫化铁（FeS₂）。HgS（E错）为朱砂的主要成分。朱砂：【来源】为硫化物类矿物辰砂族辰砂。主含硫化汞（HgS）。As₂S₃（A错）的药材，2022年考试指南未明确说明。